有关结核性腹膜炎临床表现的描述正确的是
A. 主要表现为腹痛腹胀，结核中毒症状少见
B. 为局限的慢性化脓性腹膜炎
C. 青壮年多见，男女比例约1：2
D. 多数可触及腹部包块
E. 多数可伴有肝脾结核

正确答案：C。青壮年多见，男女比例约1：2

解析：结核性腹膜炎是由结核分枝杆菌引起的慢性弥漫性腹膜感染，而不是局限的慢性化脓性腹膜炎（B错）。本病可见于任何年龄，以中青年多见，男女之比约为1﹕2（C对）。结核毒血症常见，主要是低热与中等热，可有盗汗（A错）。腹部包块少见（D错），在粘连型或干酪型可触及腹部包块。本病主要由肠系膜淋巴结结核、输卵管结核、肠结核直接蔓延而来，少数由粟粒性肺结核经淋巴血行播散而来，肝脾结核少见（E错）。